男，60岁。背部无痛性肿块5年，约鸽蛋大小，未见增大。查体：右肩胛下皮下一圆形肿块，直径约3.5cm，与皮肤粘连，表面有黑头，质稍硬，无压痛，边界清。其最可能的诊断是
A. 皮脂囊肿
B. 畸胎瘤
C. 鳞状细胞癌
D. 脂肪瘤
E. 纤维瘤

正确答案：A。皮脂囊肿

解析：患者肿块发生于背部皮下，五年未见增大，无痛，表面有黑头，与皮肤粘连，边界清，多为良性疾病，最可能的诊断为皮脂囊肿（A对）。皮脂囊肿为皮脂腺排泄受阻所致潴留性囊肿。多见于皮脂腺分布密集部位如头面及背部。表面可见皮脂腺开口的小黑点，即黑头。畸胎瘤（B错）是来源于生殖细胞的肿瘤，好发于颅内、胃、卵巢及睾丸等部位，一般不发生与皮下。鳞状细胞癌（C错）早期即可成溃疡，表面呈菜花状，边缘隆起不规则，易出血。脂肪瘤（D错）表面无黑头，且一般体积较大。